男性，25岁，车祸伤1小时，查体：脉搏130次/分，血压86/60mmHg，烦躁不安，发绀，严重呼吸困难，皮肤湿冷，左颈胸部皮下捻发感，气管右移，左胸饱满，左肺呼吸音消失，胸片示左肺完全萎陷。最可能的诊断为
A. 左侧进行性血胸
B. 左侧闭合性气胸
C. 左侧开放性气胸
D. 左侧张力性气胸
E. 左侧反常呼吸运动

正确答案：D。左侧张力性气胸

解析：男性，25岁，车祸伤1小时，查体：脉搏130次/分，血压86/60mmHg（血压下降，提示腔静脉回流障碍），烦躁不安，发绀，严重呼吸困难，皮肤湿冷（休克，缺氧），左颈胸部皮下捻发感（皮下气肿），气管右移，左胸饱满，左肺呼吸音消失，胸片示左肺完全萎陷（提示左侧胸膜腔压力高于大气压），综上考虑诊断为左侧张力性气胸（D对）。左侧进行性血胸（A错）胸片可见胸腔积液征象。左侧闭合性气胸（B错）症状较轻，不会出现休克症状，胸片肺萎缩程度较小。左侧开放性气胸（C错）会出现纵膈扑动。左侧反常呼吸运动（E错）出现在多处肋骨骨折时。